脑干腹侧面看不到的结构是
A. 脑桥基底部
B. 大脑脚
C. 面神经丘
D. 锥体
E. 橄榄

正确答案：C。面神经丘

解析：脑干腹侧面的结构有延髓、脑桥和中脑，延髓上可见椎体（D对）和橄榄（E对），脑桥上可见脑桥基底部（A对），中脑可见大脑脚（B对），面神经丘（C错，为本题正确选项）位于脑干的背侧面。